男性，58岁，进行性贫血，消瘦乏力半年，有时右腹隐痛，无腹泻。查体：右中腹部扪及肿块，肠鸣音活跃。行标准根治术后病理结果为DukesB期，其5年生存率为
A. 25%
B. 35%
C. 45%
D. 55%
E. 65%

正确答案：E。65%

解析：患者行标准根治术后病理结果为Dukes B期，其5年生存率可达65%（E对）。